正常妊娠时，绒毛膜促性腺激素高峰出现的时间是在妊娠的
A. 4～6周
B. 8～10周
C. 12周
D. 16周
E. 20周

正确答案：B。8～10周

解析：人绒毛膜促性腺激素至妊娠8～10周血清浓度达最高峰（B对），约持续10日后迅速下降，约在产后两周内消失。